患者，男，46岁，在静脉滴注万古霉素过程中出现红人综合征，可能的原因是
A. lgE介导的速发型过敏反应
B. 滴注速度过快，导致组胺释放而引起的非免疫性剂量相关反应
C. T细胞介导的迟发型过敏反应
D. 5-羟色胺综合征的表现
E. 药物诱导血小板减少所致的微血栓表现

正确答案：B。滴注速度过快，导致组胺释放而引起的非免疫性剂量相关反应

解析：本题考查药物的滴注速度。静脉滴注速度不仅关系到患者心脏负荷，且将影响到药物的疗效和稳定性，部分药物滴注速度过快可致过敏反应和毒性作用。万古霉素不宜肌内注射或直接静脉注
射，因滴注速度过快可致由组胺引起的非免疫性剂量相关反应（即“红人综合征”)（B对），故滴注速度必须严格控制。每0.5g至少加入100ml液体，静脉滴注时间控制在1小时以上（剂量≤lg的最小输注时间为1小时）。